某男，28岁，患慢性非细菌性前列腺炎，症见小便短赤、淋沥涩痛、尿急频数。证属肾虚湿热下注，宜选用的成药是
A. 三金片
B. 肾炎四味片
C. 癃闭舒胶囊
D. 癃清片
E. 五苓散

正确答案：A。三金片

解析：本题考查的是三金片的主治。患慢性非细菌性前列腺炎，症见小便短赤、淋沥涩痛、尿急频数。证属肾虚湿热下注，宜选用的成药是三金片（A对）。三金片：【主治】下焦湿热所致的热淋，症见小便短赤、淋沥涩痛、尿急频数；急性肾盂肾炎、慢性肾盂肾炎、膀胱炎、尿路感染见上述证候者；慢性非细菌性前列腺炎肾虚湿热下注证。肾炎四味片（B错）：【主治】湿热内蕴兼气虚所致的水肿，症见浮肿、腰痛、乏力、小便不利；慢性肾炎见上述证候者。癃闭舒胶囊（C错）：【主治】肾气不足、湿热瘀阻所致的癃闭，症见腰膝酸软、尿频、尿急、尿痛、尿线细，伴小腹拘急疼痛；前列腺增生症见上述证候者。癃清片（D错）：【主治】下焦湿热所致的热淋，症见尿频、尿急、尿痛、腰痛、小腹坠胀。亦用于慢性前列腺炎之湿热蕴结兼瘀血证，症见小便频急，尿后余沥不尽，尿道灼热，会阴、少腹、腰骶部疼痛或不适等。五苓散（E错）：【主治】阳不化气、水湿内停所致的水肿，症见小便不利、水肿腹胀、呕逆泄泻、渴不思饮。